冷刺激的温度应低于
A. 50℃
B. 45℃
C. 30℃
D. 10℃
E. 20℃

正确答案：D。10℃

解析：本题考查牙髓温度测验。牙髓温度测验是根据患牙对冷或热刺激的反应来判断牙髓状态的一种诊断方法，突然、明显的温度变化可诱发牙髓一定程度的反应或疼痛，对冷热刺激的反应可表现为敏感、迟钝或无反应。牙髓温度测验低于10℃为冷刺激（D对），高于60℃为热刺激。正常牙髓对20～50℃的水无明显不适反应（ABCE错）。